大肠杆菌核糖体的分子量约为
A. 2100kDa
B. 2300kDa
C. 2500kDa
D. 2700kDa
E. 2900kDa

正确答案：D。2700kDa

解析：各种原核细胞核糖体的性质及特点极为相似。大肠杆菌核糖体的分子量约为2700kDa，沉降系数为70S，由50S和30S两个大小亚基组成。掌握“RNA”知识点。